不属于急性重度有机磷农药中毒临床表现的是
A. 全血胆碱酯酶活性一般在30％～50％
B. 重度意识障碍
C. 肺水肿
D. 脑水肿
E. 呼吸麻痹

正确答案：A。全血胆碱酯酶活性一般在30％～50％